舍格伦综合征唾液腺肿大说法错误的是
A. 以腮腺最常见
B. 多为双侧发生
C. 与周围组织粘连
D. 界线常不甚清楚
E. 无压痛

正确答案：C。与周围组织粘连

解析：唾液腺肿大：以腮腺为最常见，也可伴下颌下腺、舌下腺及小唾液腺肿大。多为双侧，也可单侧发生。腮腺呈弥漫性肿大，边界不明显，表面光滑，与周围组织无粘连。少数病例在腺体内可触及结节状肿块，一个或多个，或呈单个较大肿块、质地中等偏软，界线常不甚清楚，无压痛，此为类肿瘤型舍格伦综合征。掌握“舍格伦综合征”知识点。